用于消毒诊室空气的臭氧消毒浓度应该
A. ≥20mg/m²
B. ≥20g/m³
C. ≥20mg/m³
D. ≥30g/m²
E. ≥30mg/m²

正确答案：C。≥20mg/m³

解析：本题考查环境消毒-空气消毒。用于消毒诊室空气的臭氧消毒浓度应该≥20mg/m³（C对）。对诊室的空气消毒可采取：①臭氧消毒：要求达到臭氧浓度≥20mg/m³，在相对湿度RH≥70%条件下，消毒时间≥30分钟；②紫外线消毒：选用可产生较高浓度臭氧的紫外线灯，以利用紫外线和臭氧的协同作用，紫外线灯照射时间应大于30分钟；③化学消毒剂或中草药消毒剂进行喷雾或熏蒸消毒方式：常用的化学消毒剂有：0.5%～1.0%的过氧乙酸水溶液熏蒸，或过氧化氢喷雾。在使用中注意所有消毒剂必须在有效期内，消毒时室内不能有人，甲醛因有致癌作用不能用于室内消毒。